男孩，4岁。左膝关节上方肿痛3个月，夜间加重。查体：左膝关节上方肿胀，压痛（+）、皮温高、静脉怒张，触及一肿物，硬而固定。X线检查示干骺端有溶骨破坏及日光放射状骨膜反应。最可能的诊断是
A. 骨巨细胞瘤
B. 骨肉瘤
C. 骨软骨病
D. 转移性骨肿瘤
E. 骨结核

正确答案：B。骨肉瘤

解析：患儿左膝关节上方有一硬而固定肿物，肿痛、夜间加重，压痛（+）、皮温高、静脉怒张（骨肉瘤典型表现），X线检查示干骺端有溶骨破坏及日光放射状骨膜反应（骨肉瘤典型影像学表现），结合患者临床表现、体查和影像学表现，其最可能的诊断为左股骨远端骨肉瘤（B对）。骨巨细胞瘤（P776）（A错）X线特征性表现为骨端偏心位、溶骨性、囊性破坏而无骨膜反应，病灶呈肥皂泡样改变。骨软骨瘤（P774）（C错）可长期无症状，X线表现为干骺端的外生性骨性突起。转移性骨肿瘤（P779）（D错）有原发肿瘤的症状和体征，常见于中老年。骨结核（P750）（E错）多见于脊柱，可有低热、盗汗等结核中毒症状，X线可见骨质破坏和椎间隙狭窄。